导致虚热证的病理变化是
A. 阳偏衰
B. 阴偏衰
C. 阳偏胜
D. 阴偏胜
E. 阳盛格阴

正确答案：B。阴偏衰

解析：阴偏衰表现为阴气不足，阴不制阳，阳气相对偏盛的虚热证。（B对）。阳偏衰（A错）的病机特点多表现为机体阳气不足，阳不制阴，阴气相对偏亢的虚寒证。阳偏胜（C错）的病机特点多表现为阳盛而阴未虚的实热证。阴偏胜（D错）的病机特点多表现为阴盛而阳未虚的实寒证。阳盛格阴（E错）又称格阴，指阳气偏盛至极，深伏于里，热盛于内，排斥阴气于外的一种病理变化，热盛于内是疾病的本质，但由于排斥阴气于外，可在原有壮热、面红、气粗、烦躁、舌红、脉数大有力等热盛于内表现的基础上，又出现四肢厥冷、脉沉伏等假寒之象，故称为真热假寒证。